八脉交会穴与阳跷脉相通的经穴是
A. 列缺
B. 外关
C. 后溪
D. 照海
E. 申脉

正确答案：E。申脉

解析：八脉交会穴中：公孙主冲脉病证，内关主阴维脉病证，后溪主督脉病证（C错），申脉主阳跷脉病证（E对），足临泣主带脉病证，外关主阳维脉病证（B错），列缺主任脉病证（A错），照海主阴跷脉病证（D错）。